痰湿内阻所致头晕的特征，是伴有
A. 胀痛
B. 刺痛
C. 眼花
D. 耳鸣
E. 昏沉

正确答案：E。昏沉

解析：头晕昏沉，兼见胸闷呕恶痰者，属痰湿内阻所致（E对）。头晕胀痛多因肝火上炎、肝阳上亢，脑神被扰所致（A错）。外伤后头晕刺痛者，多因瘀血阻滞脑络所致（B错）。头晕眼花，过劳或突然起立则甚，为气血两亏，不能上荣所致（C错）。头晕耳鸣，腰酸遗精者，多因肾虚精亏，髓海失养所致（D错）。